男性，10岁。左上后牙饮冰水时疼痛。无自发痛。口腔检查：左上Ⅴ（牙合）面广泛中龋，洞底质地较硬。叩诊（-），探诊（-），无松动。较合适的处理方法是
A. 化学疗法
B. 再矿化法
C. 窝沟封闭
D. 修复性治疗
E. 拔除

正确答案：A。化学疗法

解析：在正确情况下，第二前磨牙萌出的时间为10～12岁，患儿10岁，左上Ⅴ即将被第二前磨牙所替换，患牙在口腔内存留的时间不长，且患牙无自发痛，洞底无软化牙本质，这时可采用化学疗法（A对），即首先修整病变区外形，去除龋坏牙体组织，清洁牙面，干燥防湿，继而将化学药物如2%氟化钠溶液、8%氟化亚锡溶液、硝酸银溶液等浸润牙面，以此来治疗龋损，消除病变。再矿化法（B错）是采用人工方法使脱矿釉质或牙骨质再次矿化，恢复其硬度，终止或消除早期龋损的方法，适用于光滑面早期龋或龋易感者作预防用，患儿已形成牙合面龋洞，故不适于再矿化法。窝沟封闭（C错）主要应用于未发生龋坏的深点隙窝沟，作为预防点隙窝沟发生龋的手段。修复性治疗（D错）可去除病变组织、恢复牙体外形、提高咀嚼效能，但因患牙即将被恒牙所替换，且患牙无根尖周及牙周病变，故只需进行简单处理，去除牙髓的轻微炎症，而无需进行相对复杂的修复治疗。患牙无严重的牙髓及牙周症状，且乳磨牙早失易影响恒牙的正常排列及建合，因而不宜拔除（E错）。